根据《药品生产质量管理规范》，生产药品所用物料应符合
A. 药品标准
B. 包装材料标准
C. 生物制品规程
D. 医药行业标准
E. 制药工业标准

正确答案：A、B、C、D、E。药品标准；包装材料标准；生物制品规程；医药行业标准；制药工业标准